左侧脑干病变出现的症状是
A. 左侧周围面瘫，右侧肢体中枢性瘫痪
B. 右侧周围面瘫，右侧肢体中枢性瘫痪
C. 左侧周围面瘫，左侧肢体中枢性瘫痪
D. 右侧周围面瘫，左侧肢体中枢性瘫痪
E. 全身中枢性瘫痪

正确答案：A。左侧周围面瘫，右侧肢体中枢性瘫痪

解析：脑干内部结构主要有神经核、上下行传导束和网状结构。面神经核及以下周围神经病变会引起同侧周围性面瘫，左侧脑干病变则可导致左侧周围性面瘫。脑干部位病变会影响运动系统的锥体束，其为大脑皮质发出的下行纤维，属于上运动神经元，且在延髓锥体处交叉，故左侧脑干病变会造成右侧肢体中枢性瘫痪。综上所述，左侧脑干病变会造成左侧周围面瘫，右侧肢体中枢性瘫痪（A对）。